男，72岁。4小时前因情绪激动突发极度气急，咳嗽，咳粉红色泡沫痰，出冷汗，焦虑不安。既往COPD史20年，高血压病25年。查体：T36.2℃，P120次/分，R34次/分，BP220/130mmHg，神志模糊，端坐位，口唇发绀，无颈静脉怒张，双肺可闻及细湿啰音及哮鸣音，心率120次/分，律齐，心尖区可闻及舒张早期奔马律及2/6级收缩期杂音，腹软，双下肢无水肿。血气分析：pH7.28，PaO₂60mmHg，PaCO₂60mmHg。该患者不适宜的抢救措施是
A. 静脉滴注氨茶碱
B. 静脉注射呋塞米
C. 无创呼吸机持续加压给氧
D. 静脉滴注硝普钠
E. 静脉注射毛花苷丙

正确答案：E。静脉注射毛花苷丙

解析：患者老年男性，4小时前因情绪激动突发极度气急，咳嗽，咳粉红色泡沫痰（急性左心衰所致肺水肿征象），出冷汗，焦虑不安。既往COPD史20年，高血压病25年。查体：T 36.2℃（正常值36～37℃），P 120次/分（正常值60～100次/分），R 34次/分（正常值12～20次/分），BP 220/130mmHg（正常值<120/80mmHg），神志模糊（病情较重者可因缺氧出现神志模糊），端坐位，口唇发绀，无颈静脉怒张，双肺可闻及细湿啰音及哮鸣音，心率120次/分，律齐，心尖区可闻及舒张早期奔马律及2/6级收缩期杂音，腹软，双下肢无水肿。血气分析：pH 7.28（正常值7.35～7.45），PaO₂ 60mmHg（正常值95～100mmHg），PaCO₂ 60mmHg（正常值35～45mmHg）。根据患者病史、症状、体征及检查，诊断为考虑高血压合并急性左心衰竭。治疗时尽快缓解缺氧及严重呼吸困难，静脉滴注氨茶碱（A对）可解除支气管痉挛；静脉注射呋塞米（B对）可快速利尿，还可扩张静脉，减轻肺水肿；无创呼吸机持续加压（C对）给氧，增加肺泡内压，既可加强气体交换，又可对抗组织液向肺泡内渗透；静脉滴注硝普钠（D对）为动、静脉扩张剂，可迅速降低血压。静脉注射毛花苷丙（E错，为本题正确选项）适用于低心排综合征（如症状性低血压），该患者血压220/130mmHg，不宜使用。